具有抗病毒感染功能的因子是
A. IL-2
B. IFN-γ
C. IL-4
D. G-CSF
E. IL-10

正确答案：B。IFN-γ

解析：干扰素（INF）包括INF-α、IFN-γ（B对）、IFN-β等，是最早发现的细胞因子，因其抗病毒感染和复制的功能而得名。IL-2（A错）主要功能是刺激T细胞的生长和分化，激活NK细胞和巨噬细胞，促进CTL功能。IL-4（C错）主要功能是刺激B细胞增殖，参与Th2细胞分化，促进嗜酸性粒细胞、嗜碱性粒细胞和肥大细胞发育，促进IgE生成。G-CSF（D错）为粒细胞集落刺激因子，主要作用是刺激中性粒细胞的分化和发育，激活中性粒细胞。IL-10（E错）的主要功能是抑制活化的单核细胞产生细胞因子，抑制Th1细胞因子的产生，促进B细胞增殖。